慢性宫颈炎不包括
A. 宫颈糜烂
B. 宫颈上皮内瘤变
C. 宫颈肥大
D. 宫颈囊肿
E. 宫颈息肉

正确答案：B。宫颈上皮内瘤变

解析：子宫颈上皮内瘤变（CIN）（B错，为本题正确答案）是与子宫颈浸润癌密切相关的一组子宫颈病变，被视为癌前病变。宫颈糜烂（A对）、宫颈肥大（C对）、宫颈囊肿（D对）、宫颈息肉（E对）均为慢性宫颈炎的病理类型。